何者不是狂犬病的典型症状
A. 高度兴奋
B. 恐水怕风
C. 流涎多汗
D. 进行性昏迷
E. 进行性瘫痪

正确答案：D。进行性昏迷

解析：狂犬病是由狂犬病毒引起的一种人兽共患的中枢神经系统急性传染病。一般不会有进行性昏迷（D错，为本题正确答案）出现。前驱期多数患者有低热、头痛、食欲不振等上感样症状，少数有恶心、呕吐、全身不适；兴奋期表现为高度兴奋（A对）、恐风怕水（B对），恐水是本病的特殊症状，典型患者虽渴极而不敢饮水，见水、闻水声，或仅提水时便可引起喉肌严重痉挛，严重发作时可出现全身肌肉阵发性抽搐、呼吸困难和发绀，可死于呼吸或循环衰竭。常见流涎、多汗（C对）、体温升高、心率加快、血压增高等交感神经功能亢进表现。麻痹期，肌肉痉挛停止，全身弛缓性瘫痪（E对），患者由安静进入昏迷状态，最后因呼吸、循环衰竭而死亡。